离心性心肌肥大的主要机制是：
A. 收缩期阻力过大
B. 冠脉流量增加
C. 心率加快
D. 心输出量增加
E. 舒张期室壁张力增加

正确答案：E。舒张期室壁张力增加

解析：心脏前负荷长期过重时，舒张期室壁张力增加（E对），刺激心肌串联性增生，并最终发生离心性肥大。收缩期阻力过大（A错）时，心室射血所要克服的阻力即后负荷增加，使收缩期室壁张力增加，刺激心肌肌节并联性增生，并最终发生向心性肥大。